体内CO₂分压最高的部位是
A. 动脉血
B. 静脉血
C. 毛细血管血液
D. 组织液
E. 细胞内液

正确答案：E。细胞内液